抑制细菌核酸合成
A. 头孢米诺
B. 磺胺甲噁唑甲氧苄啶
C. 利福喷丁
D. 头孢吡肟
E. 依替米星

正确答案：C。利福喷丁

解析：本题考查利福喷丁。抑制细菌核酸合成的是利福喷丁（C对）。利福喷丁主要是通过作用于病原菌的遗传物质，起到抗菌的作用，能够抑制RNA的合成，防止酶与DNA连接，从而阻止RNA的转录过程，使DNA和蛋白质的合成停止。头孢米诺（A错）为头霉素类抗生素，其对β-内酰胺酶高度稳定。本品与β-内酰胺抗生素作用点青霉素结合蛋白有很强的亲和性，能抑制细胞壁的生物合成，并能结合于肽多糖，抑制肽多糖与脂蛋白结合而促进溶菌。此外，本品还能与革兰阴性菌特有的外膜脂蛋白的二氨基庚二酸结合，在短时间内显示其很强的双重杀菌作用。磺胺甲噁唑甲氧苄啶（B错）中SMZ作用于二氢叶酸合成酶，干扰合成叶酸的第一步，TMP作用于叶酸合成代谢的第二步，选择性抑制二氢叶酸还原酶的作用，两者合用可使细菌的叶酸代谢受到双重阻断。头孢吡肟（D错）属于头孢菌素类抗生素，其作用机制与青霉素相同，主要通过干扰细菌细胞壁主要成分-肽聚糖的合成发挥抗菌作用。依替米星（E错）属于氨基糖苷类抗菌药，其作用机制主要是抑制细菌蛋白质的合成，还可影响细菌细胞膜屏障功能，导致细菌细胞死亡。进入细胞后，氨基糖苷类与核糖体30S亚基结合，影响蛋白质合成过程的多个环节，抑制细菌蛋白质合成。